急性低钾血症对神经肌肉组织膜电位的影响是
A. 静息电位（负值）不变，阈电位（负值）升高，静息电位与阈电位间差距升高
B. 静息电位（负值）不变，阈电位（负值）降低，静息电位与阈电位间差距降低
C. 静息电位（负值）升高，阈电位（负值）升高，静息电位与阈电位间差距升高
D. 静息电位（负值）升高，阈电位（负值）不变，静息电位与阈电位间差距升高
E. 静息电位（负值）下降，阈电位（负值）不变，静息电位与阈电位间差距降低

正确答案：D。静息电位（负值）升高，阈电位（负值）不变，静息电位与阈电位间差距升高

解析：急性低钾血症时由于细胞外液钾浓度急剧降低，细胞内液钾浓度和细胞外液钾浓度的比值变大，静息电位(Em)负值增大（ABE错），与阈电位(Et)之间的距离(Em-Et)增大（D对），细胞兴奋性降低。钾离子浓度改变不影响阈电位水平（C错）。